以下哪一项属于细菌个体的繁殖方式
A. 有性繁殖
B. 无性繁殖
C. 出芽繁殖
D. 菌丝断裂
E. 复分裂方式

正确答案：B。无性繁殖

解析：细菌以简单的二分裂方式进行无性繁殖，并向不同平面分裂而形成细菌排列方式的不同。掌握“细菌的生理”知识点。